某温度计厂男工，42岁，工作十余年。近来有乏力、记忆力减退、失眠和多梦等症，常因琐事与人口角、事后又忧郁胆怯，近日发现他的字迹弯弯曲曲。除上述临床表现外，该工人还应具有的典型临床表现是
A. 类神经症
B. 口腔炎
C. 化学性肺炎
D. 腹绞痛
E. 肝损伤

正确答案：B。口腔炎

解析：本题考查汞中毒的典型症状。汞中毒初期表现为类神经症，如头昏、乏力、健忘、失眠、多梦、易激动等，部分病例可有心悸、多汗等自主神经系统紊乱现象，病情进一步发展则会发生性格改变，如急躁、易怒、胆怯、害羞、多疑等。震颤是神经毒性的早期症状，如头部震颤和运动失调。题中工人的自主神经系统紊乱和性格改变等现象是由于长期接触汞引起的慢性汞中毒。当发生慢性汞中毒时，会出现易兴奋症、震颤和口腔炎（B对ACDE错）的症状，题中易兴奋症和震颤表现明显，因此工人应当还存在口腔炎这一典型症状。